人参皂苷Rb₁属于
A. 四环三萜皂苷
B. 五环三萜皂苷
C. 甾体皂苷
D. 强心苷
E. 氰苷

正确答案：A。四环三萜皂苷

解析：本题考查的是人参皂苷Rb₁分类。人参皂苷Rb₁属于四环三萜（A对）。人参含有皂苷、多糖和挥发油等多种化学成分，人参皂苷为人参的主要有效成分之一。《中国药典》以人参皂苷为指标成分对人参、红参和人参叶进行含量测定。其中，人参和红参的质量控制成分为人参皂苷Rg₁、人参皂苷Re和人参皂苷Rb₁。例如，要求人参中人参皂苷Rg₁和人参皂苷Re的总量不得少于0.30%，人参皂苷Rb₁不得少于0.20%。人参皂苷可以分为三类，分别是人参皂苷二醇型（A型）、人参皂苷三醇型（B型）和齐墩果烷型（C型）。（1）人参皂苷二醇型：人参皂苷二醇型包括人参皂苷Rb₁、人参皂苷Rc和人参皂苷Rd等。（2）人参皂苷三醇型：人参皂苷三醇型包括人参皂苷Re、人参皂苷Rf和人参皂苷Rg₁等。（3）齐墩果烷型：齐墩果烷型包括人参皂苷Ro等。A型、B型的皂苷元属于四环三萜，C型皂苷元则属于五环三萜。A型和B型皂苷元属达玛烷型，为达玛烯二醇的衍生物。三萜的种类很多，但以皂苷形式存在的三萜类型并不多，较为常见的有羊毛甾烷型、达玛烷型、齐墩果烷型、乌苏烷型和羽扇豆烷型，其中前两种属于四环三萜，后三种则属于五环三萜。1.四环三萜：结构与甾醇很类似。主要有以下类型。（1）羊毛甾烷型，如猪苓酸A。（2）达玛烷型，如20（S）-原人参二醇。2.五环三萜（B错）：主要有以下类型。（1）齐墩果烷型，此类以齐墩果酸最为多见。（2）乌苏烷型，此类大多是乌苏酸的衍生物。（3）羽扇豆烷型，如羽扇豆种子中存在的羽扇豆醇，酸枣仁中分得的白桦醇和白桦酸等。甾体皂苷（C错）分类主要有螺旋甾烷醇类、异螺旋甾烷醇类、呋甾烷醇类和变形螺旋甾烷醇类。强心苷（D错）由强心苷元与糖缩合而成。天然存在的强心苷元是C₁₇侧链为不饱和内酯环的甾体化合物。氰苷（E错）主要指一类α-羟腈的苷，属于氧苷的一种。如苦杏仁苷等。